关于生物监测，不正确的是
A. 现场生物监测可进行细胞遗传学或分子毒理学的直接检测
B. 现场生物监测方法简单、快速、经济
C. 生物监测能反映总体的污染水平和可能产生的危害
D. 环境样品的生物监测不必采用浓缩或萃取的前处理
E. 可采用现场环境样品的混合物进行毒理学研究

正确答案：D。环境样品的生物监测不必采用浓缩或萃取的前处理

解析：本题考查生物监测的相关内容。生物监测是利用生物个体、种群或群落对环境污染或变化所产生的反应阐明环境污染状况，从生物学角度为环境质量的监测和评价提供依据。生物监测能反映总体的污染水平和可能产生的危害（C对）。现场生物监测可进行细胞遗传学或分子毒理学的直接检测（A对），其方法简单、快速、经济（B对）。根据环境介质及污染物的理化特性，环境样品的生物监测采用不同的浓缩、萃取等方法处理（D错，为本题正确答案），获取环境样品的混合物进行毒理学测试（E对），也有部分研究者将混合物再分为各种组分（酸性组分、碱性组分等）或单个污染物成分进行测试。